活动后左腰部绞痛，伴肉眼血尿、恶心、呕吐。首先考虑的疾病是
A. 泌尿系结石
B. 慢性肾炎
C. 泌尿系肿瘤
D. 肾脏自发性破裂
E. 肾结核

正确答案：A。泌尿系结石

解析：活动后腰部绞痛，伴血尿是典型泌尿系统结石表现，恶心呕吐是由于输尿管与肠有共同的神经支配而导致，与肾绞痛并发（A对）；慢性肾炎以蛋白尿、血尿、高血压和水肿为基本表现（B错）；血尿、肾区疼痛和腹部肿块是肾癌的典型表现，中老年患者出现无痛性肉眼血尿，考虑泌尿系上皮肿瘤（C错）；肾本身病变时，轻微外伤可造成严重的自发性肾破裂，该患者无外伤史（D错）；无明显原因的慢性膀胱炎，症状持续存在并逐渐加重，伴有终末血尿，青壮年多见，尿道培养无细菌生长，抗菌治疗无效，考虑肾结核（E错）。